慢性化脓性骨髓炎好发于
A. 下颌切牙区
B. 下颌磨牙区
C. 上颌磨牙区
D. 上颌切牙区
E. 上颌尖牙区

正确答案：B。下颌磨牙区

解析：慢性化脓性骨髓炎：可来自于急性骨髓炎治疗不当，或由毒力弱的细菌感染引起。下颌磨牙区好发，患部可表现不同程度的疼痛和肿胀。掌握“急慢性化脓性颌骨骨髓炎”知识点。